25岁初产妇，妊娠40周，规律宫缩4小时，枕左前位，估计胎儿体重3000g，胎心140次/分。阴道检査：宫口开大3cm，未破膜，S+1，骨盆外测量未见异常。若此后宫缩逐渐减弱，产程达14小时，胎膜己破，宫口开大7cm，此时恰当处理应是
A. 静注地西泮
B. 肌内注射缩宫素
C. 静脉滴注缩宫素
D. 静脉注射麦角新碱
E. 立即行剖宫产术

正确答案：C。静脉滴注缩宫素

解析：青年初产妇，妊娠40周（妊娠28周及以后为妊娠晚期），从宫口开大3cm到7cm（活跃期是宫口扩张3～10cm），用时10小时（＞8小时），为活跃期延长。此时胎膜已破，而宫缩逐渐减弱，应首先静脉滴注缩宫素加强宫缩（C对）。静脉滴注缩宫素用于催产，肌肉注射缩宫素用于产后出血（B错）。静脉注射麦角新碱（D错）可选择性兴奋子宫平滑肌，但剂量稍大即可引起子宫平滑肌强直收缩，妊娠后期子宫对其敏感性增强，因此不能用于催产和引产，只能用于产后子宫出血。静注地西泮（P189）（A错）主要用于宫口扩张缓慢合并宫颈水肿者。立即行剖宫产术（E错）适用于经上述处理后产程仍无进展或出现胎儿窘迫者。